人们对于口腔健康各方面的看法和观念指的是
A. 口腔健康知识
B. 口腔流行病学资料
C. 口腔健康行为
D. 口腔保健方法
E. 口腔健康态度

正确答案：E。口腔健康态度

解析：口腔健康态度是人们对于口腔健康各方面的看法和观念。掌握“口腔健康问卷调查”知识点。